男性，25岁。主诉心前区疼痛2小时，向左肩放射，吸气时疼痛加重，坐位时减轻，伴有畏寒、发热就诊，体检：血压105/75mmHg，体温38度，心率110次/分，规则，心脏无杂音，两肺未见异常，有血吸虫病史。心电图示除aVR与V₁外各导联ST段抬高。其最可能的诊断是
A. 肺梗死
B. 心肌梗死
C. 急性心包炎
D. 心肌梗死伴继发心包炎
E. 心肌炎

正确答案：C。急性心包炎

解析：患者青年男性，心前区疼痛2小时，向左肩放射，吸气时疼痛加重，坐位时减轻（急性心包炎的典型胸痛特点），伴有畏寒发热（提示可能有病毒感染）；心电图示除aVR与V₁外各导联ST段抬高（急性心包炎常见的心电图表现），根据患者的急性起病、典型胸痛和心电图表现，其最可能的诊断是急性心包炎（C对）。肺梗死（A错）的主要症状为突发胸痛，之后出现胸闷、气短，大约2～3天出现咯血，此类患者多有下肢骨折史、静脉曲张以及心肺疾病等。心肌梗死（B错）多表现为常表现为突发胸骨后压榨性疼痛，但疼痛性质与呼吸和体位无关。